决定土壤环境容量的因素，不正确的是
A. 污染物的性质
B. 土壤净化能力的大小
C. 污染物的总量
D. 土壤的背景值
E. 污染物的来源

正确答案：E。污染物的来源

解析：本题考查决定土壤环境容量的因素。土壤环境容量又称土壤负载容量，是一定土壤环境单元在一定时限内遵循环境质量标准，即维持土壤生态系统的正常结构与功能，保证农产品的生物学产量与质量，在不使环境系统污染的前提下，土壤环境所能容纳污染物的最大负荷量。决定土壤环境容量的因素有：污染物的性质（A对）；土壤净化能力的大小（B对）；污染物的总量（C对）；土壤的背景值（D对）。污染物的来源（E错，为本题正确答案）不是决定土壤环境容量的因素。